腹部闭合性损伤最常受损的器官是
A. 肝
B. 胃
C. 肾
D. 胰
E. 脾

正确答案：E。脾

解析：腹部闭合性损伤中，常见受损脏器依次是脾（E对）、肾（C错）、小肠、肝（A错）、肠系膜。腹部开放性损伤中，常见受损脏器依次是肝、小肠、胃（B错）、结肠、大血管等。胰（D错）、十二指肠等由于解剖位置较深，较少发生损伤。